突发事件应急工作应当遵循的方针是
A. 统一领导统一指挥
B. 统一领导分级负责
C. 调查控制和医疗救治
D. 预防为主
E. 预防为主常备不懈

正确答案：E。预防为主常备不懈

解析：《突发公共卫生应急条条例》规定，突发事件应急工作，应当遵循预防为主、常备不懈的方针（E对），统一领导、分级负责、反应及时、措施果断、依靠科学、加强合作的原则（ABCD错）。